蛛网膜下隙内的脑脊液，渗透入上矢状窦内，所通过的结构是
A. 脉络丛
B. 蛛网膜粒
C. 脑蛛网膜
D. 大脑镰
E. 软脑膜

正确答案：B。蛛网膜粒

解析：大脑背面的蛛网膜下隙，经蛛网膜粒（B对）渗透到上矢状窦，回流入血液中。